关于小脑幕
A. 分隔两侧小脑半球
B. 海马旁回位于小脑幕切迹的上方
C. 小脑幕切迹疝对脑神经无影响
D. 以上都对
E. 以上都不对

正确答案：B。海马旁回位于小脑幕切迹的上方

解析：小脑幕呈半月形伸入大脑横裂，分隔大脑和小脑（A错）。其后外侧缘附于枕骨横窦沟和颞骨岩部上缘，前内侧缘游离形成小脑幕切迹。小脑幕将颅腔不完全地分割成上下两部，当上部颅脑病变引起颅内压增高时，小脑幕切迹上方的海马旁回（B对）和钩可受挤压而移位至小脑幕切迹，形成小脑幕切迹疝压迫大脑脚和动眼神经（C错），出现相应的临床症状和体征。